营养素是指
A. 富含蛋白质、脂肪等一类化合物
B. 是人类为生存，健康而从外界摄取的食物
C. 无机盐，维生素等营养物质的总称
D. 碳水化合物、蛋白质、脂肪等机体需要的营养物质
E. 食物中所含的营养成分

正确答案：E。食物中所含的营养成分

解析：营养素是指食物中所含的营养成分。食物的营养物质其化学性质或生理功能可分为5大类：蛋白质、脂肪、碳水化合物、维生素、矿物质。掌握“合理营养指导”知识点。